未开封的胰岛素注射液适宜的保存温度是
A. -20℃～-2℃
B. -2℃～2℃
C. 2℃～10℃
D. 10℃～20℃
E. 20℃～30℃

正确答案：C。2℃～10℃

解析：本题考查药品的贮存。未开封的胰岛素注射液适宜在冷处贮存，其保存温度为2℃～10℃（C对）。